龙胆草的功效是
A. 泻肝火
B. 退虚热
C. 安胎
D. 养阴清热
E. 清心火

正确答案：A。泻肝火

解析：本题考查的是龙胆的功效。龙胆草的功效除泻肝火（A对）。龙胆草即龙胆。龙胆：【功效】清热燥湿，泻肝胆火。黄柏：【功效】清热燥湿，泻火解毒，退虚热（B错）。黄芩：【功效】清热燥湿，泻火解毒，止血，安胎（C错）。生地黄：【功效】清热凉血，养阴生津（D错），润肠。苦参：【性能特点】本品大苦大寒纯阴，清燥降利下行，药力较强，主入心、肝、胃经，兼入大肠与膀胱经。既清热燥湿，使湿热从内而解；又利尿，导湿热火毒从小便而出；还祛风杀虫而止痒。功似黄连而力较弱，尤善清心火（E错）、除中下焦湿热。凡湿热、风、虫所致疮疹痒痛皆宜，湿热痒痛、阴痒带下兼风、虫者尤佳。